口腔颌面部由于微生物感染产生的脓液形状或者颜色正确的是
A. 链球菌一般为淡黄色黏稠脓液
B. 金黄色葡萄球菌为黄色稀薄脓液
C. 链球菌有时因为溶血而使稀薄的脓液呈现褐色
D. 绿脓杆菌的典型脓液为墨绿色
E. 绿脓杆菌的典型脓液质地为稀薄、灰白或灰褐色脓液

正确答案：C。链球菌有时因为溶血而使稀薄的脓液呈现褐色

解析：本题考查口腔颌面部感染概论。口腔颌面部由于微生物感染产生的脓液形状或者颜色正确的是链球菌有时因为溶血而使稀薄的脓液呈现褐色（C对）。当急性炎症局限成脓肿后，由于主要感染菌种的不同，其脓液性状也有差异，如金黄色葡萄球菌为黄色黏稠脓液（B错）；链球菌一般为淡黄稀薄脓液（A错），有时由于溶血而呈褐色；绿脓杆菌的典型脓液为翠绿色（DE错），稍黏稠，有酸臭味；混合细菌感染则为灰白或灰褐色脓液，有明显的腐败坏死臭味。